一般的择期手术病人的静息能量消耗值（REE）约增加
A. 10%
B. 20%
C. 30%
D. 40%
E. 50%

正确答案：A。10%

解析：一般的择期手术病人的静息能量消耗值（REE）约增加10%（A对），创伤、感染增加20%～30%，大面积烧伤增加50%～100%。